关节腔叙述错误的是
A. 关节囊与关节面围成的密闭腔隙
B. 呈正压
C. 滑液由关节囊滑膜层分泌
D. 滑液具有营养作用
E. 膝关节腔与髌上囊相通

正确答案：B。呈正压

解析：关节腔为关节囊滑膜层和关节面共同围成的密闭腔隙，内呈负压，对维持关节的稳固有一定作用 （A对B错，为本题正确答案）。滑膜富含血管网，能产生滑液（C对），是关节软骨、半月板等新陈代谢的重要媒介（D对）。膝关节腔与髌上囊相通（E对）。